在代谢过程中，主要代谢产物为环氧化物的是
A. 苯巴比妥
B. 苯妥英钠
C. 阿普唑仑
D. 卡马西平
E. 地西泮

正确答案：D。卡马西平

解析：本题考查二苯并氮䓬类药物卡马西平的结构特征与作用。卡马西平（D对）在体内代谢产物为10，11-环氧化卡马西平；巴比妥类（A错）药物的代谢途径包括取代基氧化、脱烷基、脱硫、水解开环等；苯妥英钠（B错）代谢产物为5-（4-羟基苯基）-5-苯基乙酰脲；阿普唑仑（C错）主要代谢产物为4-羟基阿普唑仑和二苯甲酮衍生物；地西泮（E错）的代谢产物为C3-羟基化合物。